口腔唾液腺中最大的是
A. 腮腺
B. 舌下腺
C. 颌下腺
D. 腭腺
E. 非上述各腺

正确答案：A。腮腺

解析：本题考查唾液腺。唾液腺由三对大唾液腺和许多散在分布的小唾液腺组成，三大唾液腺包括腮腺、下颌下腺、舌下腺，其中腮腺是人体最大的唾液腺（A对），下颌下腺是第二大唾液腺（C错），舌下腺是三对唾液中最小（B错）。腭腺属于小唾液腺（D错）。